女，35岁。双侧颈部淋巴结肿大1月余，发热1周。既往体健。查体：T38.1℃，双侧颈部可触及数个肿大淋巴结，最大者2cmX2cm，质韧，无触痛。左颈部淋巴结活检见正常结构消失，代之以均—中－大型淋巴细胞浸润。免疫组化：CD20（+），CD30（—），CD5（—）。最可能的诊断是
A. 弥漫性大B细胞淋巴瘤
B. 霍奇金淋巴瘤
C. 套细胞淋巴瘤
D. 滤泡性淋巴瘤
E. 间变性大细胞淋巴瘤

正确答案：A。弥漫性大B细胞淋巴瘤

解析：患者双侧颈部淋巴结肿大1月余，查体示双侧颈部可触及数个肿大淋巴结，左颈部淋巴结活检见正常结构消失，代之以均—中－大型淋巴细胞浸润（弥漫性大B细胞淋巴瘤的病理变化），免疫组化CD20（+）、CD30（-）及CD5（-），该患者最可能的诊断是弥漫性大B细胞淋巴瘤（A对）。霍奇金淋巴瘤（B错）病变往往从一个或一组淋巴结开始，逐渐由近及远地向周围的淋巴结扩散，镜下有典型的R-S细胞。套细胞淋巴瘤（C错）常见免疫组化为CD20、CD79a、CD43、CD5。滤泡性淋巴瘤（D错）主要表现为局部或全身淋巴结无痛性肿大，免疫表型表达CD19、CD20、CD10、Bc16和单克隆性的表面lg。间变性大细胞淋巴瘤（E错）常有皮肤侵犯，最常见的免疫组化是CD30。